女，58岁。进行性黄疸15天。恶心、厌食，腹胀，无腹痛，近5天大便发白，陶土样，尿呈浓茶样。查体：巩膜皮肤黄染，可触及肿大胆囊，无压痛。首选的影像学检查是
A. 内镜逆行性胰胆管造影
B. 经皮肝穿刺胆道造影
C. 腹部B超
D. 磁共振胰胆管成像
E. 静脉法胆道造影

正确答案：C。腹部B超

解析：老年女性患者，进行性黄疸15天，白陶土样便、尿呈浓茶样5天（提示胆道梗阻严重），伴恶心、厌食、腹胀。体查：巩膜皮肤黄染，可触及肿大胆囊，无压痛（胆管下段癌）。综合该患者的病史及体查，初步诊断考虑胆管下段癌。（胰头癌应排除，因胰头癌上腹疼痛常作为首发症状；壶腹癌应排除，因未提及波动性黄疸。）在选项所给出的影像学检查中，首选腹部B超（C对）。操作简单，方便易行且为无创性检查，可显示肝内、外胆管扩张，胆囊胀大，胰管扩张，胰头部占位病变，同时可观察有无肝转移和淋巴结转移，对于胰腺肿瘤的诊断有重要价值。内镜逆行性胰胆管造影（A错）、经皮肝穿刺胆道造影（B错）、静脉法胆道造影（E错）仅可显示胆道梗阻，对于胆道外病变仅有间接提示价值，且不能明确肿块具体部位。磁共振胰胆管成像（D错）能显示胰、胆管梗阻部位、扩张程度，多角度成像，定位准确，但其价格昂贵且操作繁琐，一般不作为首选检查。注：临床上胰腺肿瘤病人的首选影像学检查为CT。